HIV主要感染的细胞不包括
A. CD4⁺T淋巴细胞
B. 单核-吞噬细胞
C. kupffer细胞
D. B淋巴细胞
E. 小神经胶质细胞

正确答案：C。kupffer细胞

解析：获得性免疫缺陷综合症（艾滋病）是由人类免疫缺陷病毒（HIV）感染引起的继发性免疫缺陷病，HIV既嗜淋巴细胞、又嗜神经细胞，主要感染CD4⁺T细胞以及单核-吞噬细胞、B淋巴细胞（B细胞）、小神经胶质细胞和骨髓干细胞等。kupffer细胞（C错，为本题正确答案）即肝脏巨噬细胞，肝炎时可见大量kupffer细胞增生。